女孩，5岁。因间断发热伴痉挛性咳嗽20天来诊。体温38℃，神志清。慢性病容，右眼结膜充血。内眦部有一疱疹，咽部有充血，右颈部可触及豌豆大小淋巴结，无明显压痛，心、肺无异常。肝肋下1.0cm，胸透肺门可见3cm×3cm阴影，外周血白细胞5.6×10⁹/L，淋巴细胞0.7。该患儿最佳治疗方案
A. 红霉素口服
B. 红霉素+氨苄西林
C. 异烟肼+利福平
D. 异烟肼+对氨基水杨酸
E. 长春新碱+环磷酰胺+泼尼松

正确答案：C。异烟肼+利福平

解析：学龄前儿童，间断发热伴痉挛性咳嗽（支气管淋巴结结核压迫气管分叉处症状）20天来诊，体温38℃（正常值为36℃～37℃，发热），神志清，慢性病容，右眼结膜充血，内眦部有一疱疹（疱疹性结膜炎），咽部有充血，右颈部可触及豌豆大小淋巴结，无明显压痛，肝肋下1.0cm（提示肝脏增大），胸透肺门可见3cm×3cm阴影（支气管淋巴结结核的典型X线表现），外周血白细胞5.6×10⁹/L（正常值为4～10×10⁹/L），淋巴细胞0.7（正常值为0.2～0.4，淋巴细胞增高），根据患儿的临床症状、体征及实验室检查，考虑最可能的诊断为支气管淋巴结结核，该患儿最佳治疗方案异烟肼+利福平（C对），选项中只有这两种药属于抗结核药物，可有效治疗结核，其他药物对结核的治疗并没有效果。